在耳用制剂中，可作为溶剂的是
A. 硫柳汞
B. 亚硫酸氢钠
C. 甘油
D. 聚乙烯醇
E. 溶菌酶

正确答案：C。甘油

解析：本题考查耳用制剂中辅料的作用。在耳用制剂中，可作为溶剂的是甘油（C对）。耳用制剂的常用溶剂与附加剂：（1）常用溶剂：水、乙醇、甘油；（2）附加剂：①抗氧剂：亚硫酸氢钠（B错）；②抑菌剂：硫柳汞（A错）；③药物分散剂：溶菌酶（E错）、透明质酸酶等；聚乙烯醇（D错）为成膜材料。